中、晚餐前血糖控制较满意。根据目前情况，下列哪项治疗方案是最佳选择
A. 双胍类降糖药
B. 长效胰岛素治疗
C. 短效胰岛素治疗
D. 磺脲类降糖药治疗
E. 混合胰岛素治疗

正确答案：B。长效胰岛素治疗

解析：患者青年女性（TIDM常见发病年龄），多饮、多尿、纳差伴体重下降半年（糖尿病主要临床表现）。体检：身高161cm，体重 55kg（BMI21.2，正常值18.5～23.9），血糖19.2 mmol/L（≥11.1 mmol/L），尿酮（+）（正常阴性，多见于T1DM）。结合患者临床表现及实验室检查，考虑患者为T1DM。在治疗1个月后空腹血糖为14mmol/L（考虑黎明现象或苏木杰反应）， 中、晚餐前血糖控制较满意。黎明现象或苏木杰反应难以鉴别时，不应口服降糖药物，应在夜间多次测量血糖加以鉴别，若为黎明现象则在睡前加用中长效胰岛素治疗（B对C错）；苏木杰反应的糖尿病患者来说，应减少作用于晚餐前的口服降糖药物或胰岛素剂量。双胍类降糖药（A错）、磺脲类降糖药（D错）主要适用于T2DM，T1DM治疗主要依靠胰岛素。预混胰岛素治疗（E错）峰值早于长效胰岛素，不适用于晨间空腹血糖升高的患者。